组成药物中含有连翘的方剂是
A. 温胆汤
B. 凉膈散
C. 淸骨散
D. 温脾汤
E. 清胃散

正确答案：B。凉膈散

解析：本题考查方剂中药物组成，属记忆内容。凉膈散功用泻火通便，清上泄下，由川大黄、 朴硝、甘草、山栀子仁、薄荷、黄芩、连翘组成（B对）。温胆汤功用理气化痰，和胃利胆，由半夏、竹茹、枳实、陈皮、甘草、茯苓组成（A错）。淸骨散功用清虚热，退骨蒸，由银柴胡、胡黄连、秦艽、鳖甲、地骨皮、青蒿、知母、甘草组成（C错）。温脾汤功用攻下冷积，温补脾阳，由大黄、当归、干姜、附子、人参、芒硝、甘草组成（D错）。清胃散功用清胃凉血，由生地黄、当归身、牡丹皮、黄连、 升麻组成（E错）。记忆：凉膈散，凉膈硝黄栀子翘，黄芩甘草薄荷饶，再加竹叶调蜂蜜，上中郁热服之消。